化妆品卫生监督条例
A. 是针对化妆品生产制订的
B. 是针对化妆品经营制订的
C. 针对卫生监督制订的
D. 针对化妆品的生产和经营制订的
E. 针对化妆品生产、经营和监督而制订的

正确答案：E。针对化妆品生产、经营和监督而制订的

解析：本题考查化妆品卫生监督条例。《化妆品卫生监督条例》是针对化妆品生产、经营和监督而制订的（E对ABCD错）。